一男性患者1个月前感到疲劳、食欲减退、发热咳嗽、咳痰带血丝，取咳痰进行抗酸染色，镜下见到红色细长弯曲、分枝的杆菌，试问该细菌最有可能是何种细菌
A. 白喉棒状杆菌
B. 肺炎克雷伯菌
C. 炭疽芽胞杆菌
D. 结核分枝杆菌
E. 流感嗜血杆菌

正确答案：D。结核分枝杆菌